下列哪种脂类是合成前列腺素必需的前体
A. 油酸
B. 亚麻酸
C. 花生四烯酸
D. 磷脂
E. 胆固醇

正确答案：C。花生四烯酸